属于医德活动现象的是
A. 医德修养
B. 医德原则
C. 医德情感
D. 医德意志
E. 医德理论

正确答案：A。医德修养

解析：该题属于理解型题目，所以基于对医德活动现象概念的理解，可判断医德修养是属于医德活动现象，因为修养是通过行为可以判断善恶的（A对）。而医德原则，医德意志，医德理论是一个固有概念，不属于医德活动现象（BDE错）。而医德情感也不属于医德活动现象（C错）。